患儿近日常感无力，精神萎靡，食欲不佳，并诉右上腹隐痛。检查：面色黄，肝于肋缘下3cm可触及，有压痛。实验室检查：尿胆红素（+），尿胆原（+）。应首先考虑的是
A. 蚕豆病
B. 胃炎
C. 胆道蛔虫症
D. 急性病毒性肝炎
E. 胆结石

正确答案：D。急性病毒性肝炎

解析：患儿近日常感无力，精神萎靡，食欲不佳，并诉右上腹隐痛。检查：面色黄，肝脏缩小，有压痛，实验室检查：尿胆红素（+），尿胆原（+），患者临床表现及实验室检查与急性病毒性肝炎相符，故患者最可能的诊断是急性病毒性肝炎（D对）。蚕豆病（P564）（A错）即红细胞葡萄糖-6-磷酸脱氢酶缺乏症，主要表现为溶血。胃炎（P364）（B错）主要表现为上腹不适、腹胀、反酸、嗳气，常因饮食不当诱发。胆道蛔虫症（人卫八版外科学P463）（C错）主要表现为突发剑突下钻顶样剧烈绞痛，阵发性加剧，可伴有恶心、呕吐，腹痛可骤然缓解，间歇期可全无症状。胆结石（人卫八版外科学P453）（E错）主要表现为胆绞痛、上腹隐痛及胆囊积液等。